对洛美沙星进行人体生物利用度研究，采用静脉注射与口服给药方式，给药剂量均为400mg·h/ml和36㎍·h/ml。洛美沙星是喹诺酮母核8位引入氟，构效分析，8位引入氟后，使洛美沙星
A. 与靶酶DNA聚合酶作用强、抗菌活性减弱
B. 药物光毒性减少
C. 口服利用度增加
D. 消除半衰期3～4小时，需一日多次给药
E. 水溶性增加，更易制成注射液

正确答案：C。口服利用度增加

解析：本题考查喹诺酮类抗菌药。在喹诺酮类药物的6位和8位同时引入两个氟原子并在7位引入3-甲基哌嗪得到洛美沙星；8位氟原子取代基可提高口服生物利用度（C对），生物利用度可达到95%～98%；口服吸收迅速、完全且稳定性强；口服后仅有5%的药物经生物转化后代谢，60%～80%的药物以原型从尿液中排出；但8位氟原子取代可增加其光毒性（B错），盐酸洛美沙星7位取代基为体积较大的3-甲基哌嗪，可以使其消除半衰期增至7～8小时（D错）。